切面有多数淡黄色小点（维管束）排列成数轮同心环的饮片是
A. 防己
B. 柴胡
C. 龙胆
D. 川牛膝
E. 知母

正确答案：D。川牛膝

解析：本题考查的是川牛膝饮片的性状鉴别。切面有多数淡黄色小点（维管束）排列成数轮同心环的饮片是川牛膝（D对）。川牛膝：【性状鉴别】饮片呈圆形或椭圆形薄片。外表皮黄棕色或灰褐色。切面淡黄色至棕黄色，可见多数黄色点状异型维管束排成数轮同心环。气微，味甜。防己（A错）：【性状鉴别】饮片呈类圆形或半圆形的厚片。外表皮淡灰黄色。切面灰白色，粉性，有稀疏的放射状纹理。气微、微苦。柴胡（B错）：【性状鉴别】饮片北柴胡呈不规则厚片。外表皮黑褐色或浅棕色，具纵皱纹和支根痕。切面淡黄色，纤维性。质硬。气微香，味微苦。龙胆（C错）：【性状鉴别】饮片呈不规则形的段。根茎呈不规则块片，表面暗灰棕色或深棕色。根圆柱形，表面淡黄色至黄棕色，有的有横皱纹，具纵皱纹。切面皮部黄白色至棕黄色，木部色较浅，气微，味甚苦。知母（E错）：【性状鉴别】饮片呈不规则类圆形的厚片。外表皮黄棕色或棕色，可见少量残存的黄棕色叶基纤维或凹陷或突起的点状根痕。切面黄白色至黄色。气微，味微甜、略苦，嚼之带黏性。